患者，男，23岁。左侧第4、5趾间瘙痒，查体可见局部潮湿，皮肤浸渍发白，应首先考虑的诊断是
A. 皮肤瘙痒症
B. 足癣
C. 银屑病
D. 梅毒
E. 湿疹

正确答案：B。足癣

解析：患者，男，23岁，本病常见于成年男性，男性约3倍于女性，左侧第45趾间瘙痒，查体可见局部潮湿，皮肤浸渍发白为足癣糜烂型的表现（B对）。皮肤瘙痒症分为全身性瘙痒证和局限性瘙痒症，根据病史，初发时仅有症状而无皮疹可诊断（A错）。银屑病基本皮损为红斑、丘疹或斑块上覆有多层银白色鳞屑（C错）。梅毒早期侵犯皮肤粘膜，晚期可侵犯全身各器官，特别易侵犯心脏和中枢神经系统（D错）。湿疹皮损呈多样性，而慢性期则局限而浸润肥厚，瘙痒剧烈，易复发。临床表现具有多形性、渗出性、瘙痒性、对称性和复发性的特点（E错）。